男，28岁，前牙区牙龈红肿1年，龈乳头肥大呈球形，有口呼吸习惯，牙石（+），全身情况良好。此患者最可能的诊断为
A. 青春期龈炎
B. 边缘性龈炎
C. 青少年牙周炎
D. 增生性龈炎
E. 药物性牙龈增生

正确答案：D。增生性龈炎

解析：男，28岁，前牙区牙龈红肿1年，龈乳头肥大呈球形，有口呼吸习惯，牙石（+），全身情况良好。此患者最可能的诊断为增生性龈炎（D对）。根据题目中的信息前牙区牙龈红肿1年，龈乳头肥大呈球形，有口呼吸习惯，可诊断为增生性龈炎。青春期龈炎，患者处于青春期，且牙龈的炎症反应超过了局部刺激因素所能引起的程度（A错）。青少年牙周炎属旧分类，实质为侵袭性牙周炎，病变进展快速，有家族聚集性，牙周组织破坏程度与局部刺激的量不成正比，第一恒磨牙和切牙会有附着丧失（C错）。药物性牙龈肥大，龈乳头呈球状、结节状，质地坚韧，有弹性，不宜出血，有长期服药史（E错）。